被人形象地称为“分子伴娘”的物质是
A. 急性期蛋白
B. CRH
C. 热休克蛋白
D. 糖皮质激素
E. 肾上腺素

正确答案：C。热休克蛋白

解析：热休克蛋白（C对）即HSP是被人形象地称为“分子伴娘”的物质。